女，27岁，检查：全口牙龈增生覆盖牙冠的1/2。重点询问的病史，除外
A. 妊娠史
B. 急性肝炎病史
C. 癫痫病史
D. 家族史
E. 目前身体状况

正确答案：B。急性肝炎病史

解析：本题考查牙龈炎的病因。急性肝炎（B错，为本题的正确答案）并不会导致牙龈增生，故不需询问患者是否有相关病史。牙龈增生的疾病主要有：1.药物性牙龈肥大增生；2.牙龈纤维瘤病；3.以增生为表现的慢性龈炎；4.妊娠期龈炎。根据病例描述，患者女性，27岁，全口牙龈增生覆盖牙冠的1/2，询问妊娠史（A对）可以初步判断患牙龈的增生是否为妊娠期激素水平变化导致的妊娠期龈炎。癫痫病史（C对）患者会服用抗癫痫药-苯妥英钠，该药物可以导致药物性牙龈肥大，询问该病史有助于确定是不是药物性牙龈肥大。家族史（D对）主要存在于牙龈纤维瘤病患者中，通过询问患者家里有没有其他人有类似情况，可初步判定是否为牙龈纤维瘤病导致的牙龈增生。通过询问患者目前身体状况（E对）可以了解患者是否有重大疾病或自身免疫病，以进一步确定患者是否服用免疫抑制剂而引起药物性龈增生。